细胞周期特异性药物，主要包括
A. 细胞毒素类、植物类
B. 抗生素类、代谢类
C. 代谢类、植物类
D. 代谢类、激素类
E. 激素类、植物类

正确答案：C。代谢类、植物类

解析：本题考查口腔颌面部肿瘤的治疗原则及预防。细胞周期特异性药物：主要是一些代谢类和植物类药物（C对）。它们通过抑制细胞脱氧核糖核酸的生化合成及有丝分裂而发挥作用。